可用于治疗尿崩症的药物是
A. 氨苯蝶啶
B. 螺内酯
C. 氢氯噻嗪
D. 呋塞米
E. 甘露醇

正确答案：C。氢氯噻嗪

解析：本题考查氢氯噻嗪。可用于治疗尿崩症的药物是氢氯噻嗪（C对）。氢氯噻嗪为噻嗪类利尿药，可用于治疗轻型尿崩症，减少尿崩症患者的尿量，对重症疗效差。氨苯蝶啶（A错）是保钾利尿药，用于慢性心力衰竭、肝硬化腹水、肾病综合征、糖皮质激素治疗过程中发生的水钠潴留，特发性水肿，亦用于对氢氯噻嗪或螺内酯无效者。螺内酯（B错）适用于低血钾症、高尿酸血症患者或原发性醛固酮增多症。呋塞米（D错）是高效利尿剂，可用于消除各种严重的水肿，治疗急性肺水肿和脑水肿、预防急性肾衰竭、加速中毒药物排泄。甘露醇（E错）是渗透性利尿剂，临床用于预防急性肾衰竭、脑水肿及青光眼。